下列书籍中，不属于国家药品标准的有
A. 《中华本草》
B. 《中药大辞典》
C. 《中华人民共和国药典》
D. 《中华人民共和国卫生部标准》
E. 《中华人民共和国药典临床用药须知》

正确答案：A、B、E。《中华本草》；《中药大辞典》；《中华人民共和国药典临床用药须知》

解析：本题考查的是药品标准。下列书籍中，不属于国家药品标准的有《中华本草》（A错，为本题正确答案）、《中药大辞典》（B错，为本题正确答案）与《中华人民共和国药典临床用药须知》（E错，为本题正确答案）。药品标准有：1.《中华人民共和国药典》（2015年版）（C对）；2.《中华人民共和国卫生部标准》（D对）《国家食品药品监督管理局标准》及其他。《中华本草》与《中华人民共和国药典临床用药须知》属于常用药品集和专著。常用药品集和专著：1.《中华人民共和国药典临床用药须知》；2.《中华本草》；《中国中药资源志要》；4.《中国常用药品集》；5.《中国药品使用手册•中成药专册》（2002年版）；6.《全国中草药汇编》。《中药大辞典》属于常用中医药工具书与文献。常用中医药工具书与文献：1.《中药大辞典》；2.《中国医籍大辞典》；3.《中医方剂大辞典》；4.《中医大辞典》；5.《中国医学文摘——中医》。